异羟肟酸铁反应的化合物类型是
A. 蒽醌类
B. 木脂素
C. 二萜类
D. 香豆素类
E. 二氢黄酮类

正确答案：D。香豆素类

解析：本题考查的是香豆素的显色反应。异羟肟酸铁反应的化合物类型是香豆素类（D对）。香豆素的显色反应：（1）异羟肟酸铁反应；（2）三氯化铁反应；（3）Gibb's反应；（4）Emerson反应。异羟肟酸铁反应：由于香豆素类具有内酯环，在碱性条件下可开环，与盐酸羟胺缩合成异羟肟酸，然后再在酸性条件下与三价铁离子络合成盐显红色。蒽醌类（A错）属于醌类化合物。醌类化合物的显色反应：1.Feigl反应；2.无色亚甲蓝显色试验；3.Bornträger's反应；4.Kesting-Craven反应；5.与金属离子的反应。木脂素（B错）：木脂素分子中常用的官能团为醇羟基、酚羟基、甲氧基、亚甲二氧基、羧基和内酯环，因此它也具有这些官能团所具有的化学性质。如Labat反应等。二萜类（C错）：二萜是指骨架由4个异戊二烯单位构成，含20个碳原子的一类萜类衍生物。绝大多数不能随水蒸气蒸馏。二萜多以树脂、内酯或苷等形式广泛存在于自然界。不少二萜含氧衍生物具有很好的生物活性，如穿心莲内酯、芫花酯、雷公藤内酯、银杏内酯、紫杉醇等二萜类的结构分为无环（开链）、单环、双环、三环、四环、五环等类型，天然无环及单环二萜数量较少，双环及三环二萜数量较多。二氢黄酮类（E错）属于黄酮类化合物。黄酮类化合物的显色反应多与分子中的酚羟基及γ-吡喃酮环有关，包括：1.还原试验：（1）盐酸-镁粉（或锌粉）反应；（2）四氢硼钠（钾）反应；2.金属盐类试剂的络合反应：（1）铝盐；（2）铅盐；（3）锆盐；（4）镁盐；（5）氯化锶；（6）三氯化铁；3.硼酸显色反应；4.碱性试剂显色反应。